龋病二级预防包括
A. 修复牙列缺损
B. 治疗根尖周病的牙
C. 筛选高危人群并进行防护
D. 早期充填釉质龋
E. 不充填老年牙骨质龋

正确答案：D。早期充填釉质龋

解析：二级预防：早期诊断早期处理：定期进行临床检查及X线辅助检查，发现早期龋及时充填。掌握“龋病三级预防”知识点。